男性，60岁。突然呼吸困难伴咳嗽2小时，两肺闻及哮鸣音，心率126次/分，杂音听不清。诊断支气管哮喘的主要依据
A. 血中嗜酸性粒细胞增多
B. 有阻塞性通气功能障碍
C. 血清IgE升高
D. 反复发作的呼吸困难伴哮鸣音
E. 气道激发试验阳性

正确答案：D。反复发作的呼吸困难伴哮鸣音